为提高脓毒症血培养的阳性率，抽血的最佳时间是
A. 每天晚间
B. 寒战发热后
C. 寒战发热时
D. 寒战发热前
E. 每天早晨

正确答案：C。寒战发热时

解析：脓毒症是指病原菌引起的全身性炎症反应，寒战发热说明病原菌正在活动，此时抽血作病原菌培养，阳性率最高（C对）。